优点是体积小，易自洁，不易损坏；缺点是较难修理和添加；为以上哪种类型的义齿
A. 金属铸造支架式义齿
B. 黏膜支持式义齿
C. 牙与黏膜混合支持式义齿
D. 胶连式义齿
E. 牙支持式义齿

正确答案：A。金属铸造支架式义齿

解析：金属铸造支架式义齿的优点是体积小，覆盖组织少，感觉舒适，易自洁，且强度高，不易损坏。缺点是制作工艺相对复杂，价格高，且较难修理和添加。掌握“局部义齿类型，肯氏分类及模型观测”知识点。